我国目前开展社区预防服务被认为最有效的服务单位是
A. 个人
B. 家庭
C. 人群
D. 社区
E. 疾病人群

正确答案：B。家庭

解析：社区预防服务是由全科医生为主的卫生组织或机构所从事的一种社区定向的卫生服务，它是以人的健康为中心，以家庭为单位，以社区为范围，以群体为对象开展的预防工作。社区预防服务“以家庭为单位的照顾”主要涉及两个方面的内容：1.个人和其家庭成员之间存在着相互作用，家庭的结构和功能会直接或间接影响家庭成员的健康，反过来也收到家庭成员健康或疾病状况的影响：2.家庭生活周期是家庭医学观念最基本的框架，家庭生活周期的不同阶段存在着不同的重要事件和压力，若处理不当而产生危机，则可能再家庭成员中产生相应地健康问题，对家庭成员造成健康损害。因此，我国目前开展社区预防服务被认为最有效的服务单位是家庭（B对）。